沙丁胺醇治疗支气管哮喘的机制
A. 激动β₁受体
B. 激动β₂受体
C. 激动β₁、β₂受体
D. 激动a受体
E. 激动α、β受体

正确答案：B。激动β₂受体

解析：沙丁胺醇可用于哮喘、其它原因引起的支气管痉挛、喘息型支气管炎及COPD伴喘息的治疗，它是通过选择性激动β₂受体，松弛支气管平滑肌起作用（B对ACDE错）。